吗啡的镇痛作用主要用于
A. 胃肠痉挛
B. 慢性钝痛
C. 分娩阵痛
D. 肾绞痛
E. 急性锐痛

正确答案：E。急性锐痛